小儿指纹淡红，其证候是
A. 虚寒
B. 食积
C. 痰热
D. 虚热
E. 实热

正确答案：A。虚寒

解析：小儿虚寒的指纹为淡红色（A对）。小儿食积的指纹为色紫，推之滞涩，复盈缓慢（B错）。小儿痰热的指纹为色紫，推之滞涩，复盈缓慢（C错）。小儿虚热的指纹为淡紫色（D错）。小儿实热的指纹为紫红色（E错）。